纤维结缔组织增生，粗大的胶原纤维束类似瘢痕组织结构，且炎症不明显等症状，属于以上哪项病理特征
A. 牙周萎缩
B. 牙周炎
C. 增生性龈炎
D. 慢性龈炎
E. 剥脱性龈病损

正确答案：C。增生性龈炎

解析：本题考查牙龈疾病。纤维结缔组织增生，粗大的胶原纤维束类似瘢痕组织结构，且炎症不明显等症状，属于增生性龈炎（C对）的病理特征。龈增生其主要组织病理学变化为纤维结缔组织增生，粗大的胶原纤维束类似瘢痕组织结构；还可出现胶原纤维水肿、变性及毛细血管增生、扩张、充血等变化。一般炎症不明显。